下述内容不属于临床道德原则的是
A. 保密原则
B. 生命价值原则
C. 知情同意原则
D. 身心统一原则
E. 最优化原则

正确答案：D。身心统一原则

解析：临床道德原则不包括身心统一原则（D错，为本题正确答案）。临床道德原则主要包括：1.患者至上原则：以患者为中心，诊疗质量第一，信誉为保障，经济利益与患者利益相结合（B对）。2.最优化原则：是临床诊疗最普遍、最基本的伦理原则，最优化即最佳，表现在临床上，就是尽可能以最小的医疗代价获得最大或最佳的诊疗效果。痛苦最少，损伤最小，耗费最低，疗效最佳（E对）。3.知情同意原则：包括知情和同意两个方面。所谓知情就是患方有权利知道诊断结果、治疗方案、预期效果和花费等，而医方也有义务对此进行说明。所谓同意是患方在医方所提供的足够医疗信息的基础上自主决定接受该诊疗方案的行为。知情与同意密切相关，知情是同意的前提与基础，同意是知情后的意向显现和决策结果（C对）。4.保密守信原则：包括保守患者的秘密和对患者保密（A对）。